浅部的黏液囊肿的颜色为
A. 深红色
B. 黑色
C. 浅褐色
D. 淡蓝色
E. 草绿色

正确答案：D。淡蓝色

解析：浅部的黏液囊肿其病变表面呈淡蓝色，透明易破裂。掌握“黏液囊肿”知识点。